关节的辅助结构是
A. 纤维连结、软骨连结、骨性连结
B. 韧带、关节盘、关节唇、滑膜襞、滑膜囊
C. 关节面、关节囊、关节腔
D. 直接连结和间接连结
E. 无

正确答案：B。韧带、关节盘、关节唇、滑膜襞、滑膜囊

解析：关节的辅助结构是韧带、关节盘、关节唇、滑膜囊、滑膜襞（B对）。